患者孕6月，尿频尿急尿痛，尿意不尽，欲解不能，小腹坠胀，胸闷纳少，带下量多黄稠，舌红，苔黄腻，脉弦滑数，其治法是
A. 滋阴清热，润燥通淋
B. 清热泻火，利湿通淋
C. 清热利湿，润燥通淋
D. 清热利湿，泻火通淋
E. 清心泻火，润燥通淋

正确答案：C。清热利湿，润燥通淋

解析：妊娠小便淋痛湿热下注证，表现为妊娠期间突感 尿频尿急尿痛，尿意不尽，欲解不能，小便短赤，小腹坠胀，胸闷纳少，带下黄稠量少，舌红苔黄腻，脉弦滑数，治法清热利湿，润燥通淋”（C对）。妊娠小便淋痛阴虚津亏证，治法滋阴清热，润燥通淋（A错）。妊娠小便淋痛心火偏亢证，治法清心泻火，润燥通淋（E错）。